关于尿毒症概念正确的是
A. 水、电解质、酸碱平衡紊乱
B. 急、馒性肾衰竭晚期
C. 自体中毒
D. 体内蓄积大量代谢产物及毒物
E. 以上都相关

正确答案：E。以上都相关

解析：尿毒症是急、馒性肾衰竭晚期（B对），由于肾单位大量破坏，导致代谢终末产物和毒性物质在体内大量游留（D对），并伴有水、电解质和酸碱平衡的严重紊乱（A对）以及某些内分泌功能失调，从而引起 一系列自体中毒（C对）症状的综合征。综上，以上都相关（E对）。